白色处方（右上角无标示）作为
A. 普通处方
B. 急诊处方
C. 儿科处方
D. 麻醉药品和第一类精神药品处方
E. 第二类精神药品处方

正确答案：A。普通处方

解析：本题考查处方。普通处方（A对）的印刷用纸为白色，右上角无标注。急诊处方（B错）印刷用纸为淡黄色，右上角标注“急诊”。儿科处方（C错）印刷用纸为淡绿色，右上角标注“儿科”。麻醉药品和第一类精神药品处方（D错）印刷用纸为淡红色，右上角标注“麻、精一”。第二类精神药品处方（E错）印刷用纸为白色，右上角标注“精二”。